抗瘤谱较广，还可用于治疗自身免疫性疾病的药物是
A. 阿霉素
B. 放线菌素D
C. 环磷酰胺
D. 丝裂霉素
E. 紫杉醇

正确答案：C。环磷酰胺

解析：本题考查抗肿瘤药。抗瘤谱较广，还可用于治疗自身免疫性疾病的药物是环磷酰胺（C对）。环磷酰胺抗瘤谱较广，是临床应用最广泛的烷化剂之一。对淋巴细胞有明显的抑制作用，故被用作免疫抑制剂治疗自身系统免疫性疾病如系统性红斑狼疮、类风湿关节炎等。阿霉素（A错）又叫多柔比星，用于急慢性白血病、恶性淋巴瘤等。放线菌素D（B错）对霍奇金病、绒毛膜癌和肾母细胞瘤有较好的疗效。丝裂霉素（D错）主要用于各种实体瘤，与氟尿嘧啶、多柔比星合用能有效地缓解胃腺癌和肺癌。紫杉醇（E错）为治疗卵巢癌和乳腺癌的一线药物。